常用作自来饮用水的化学试剂是
A. 乙醇
B. 碘伏
C. 甲醛
D. 含氯消毒剂
E. 戊二醛

正确答案：D。含氯消毒剂

解析：含氯消毒剂：消毒剂溶于水中可产生次氯酸者称为含氯消毒剂。目前常用的有漂白粉、三合二、次氯酸钙、二氯异氰尿酸钠、氯胺丁等5种。含氯消毒剂杀菌谱广，对细菌繁殖体、病毒、真菌孢子及细菌芽孢均有杀灭作用。掌握“口外消毒和灭菌”知识点。